治疗血瘀经闭，癥瘕，应首选的药物是
A. 酸枣仁
B. 石菖蒲
C. 僵蚕
D. 麝香
E. 冰片

正确答案：D。麝香

解析：麝香具有开窍醒神，活血通经，消肿止痛的功效，可用于闭证神昏；疮疡肿毒，瘰疬痰核；血瘀经闭，癥瘕（D对），心腹暴痛，头痛，跌打损伤，风寒湿痹；难产，死胎，胞衣不下。酸枣仁养心益肝，安神，敛汗生津的功效（A错）。石菖蒲具有开窍醒神，化湿和胃，宁神益志的功效（B错）。僵蚕具有息风止痉，祛风止痛，化痰散结的功效（C错）。冰片具有开窍醒神，清热止痛的功效（E错）。